药品说明书中【用法用量】一项
A. 应详细列出口服、皮下注射、外用等用药途径
B. 应详细说明用药过量造成的后果
C. 应准确标明药物剂量，分清儿童、成人、老龄患者的用量
D. 需要饭前、饭后、清晨、睡前服用者，应详细说明
E. 应详细说明正常用法用量情况下出现的对人体有害的反应

正确答案：A、C、D。应详细列出口服、皮下注射、外用等用药途径；应准确标明药物剂量，分清儿童、成人、老龄患者的用量；需要饭前、饭后、清晨、睡前服用者，应详细说明